血源性肺脓肿最常见的病原体是
A. 流感嗜血杆菌
B. 肺炎克雷伯杆菌
C. 肺炎链球菌
D. 铜绿假单胞菌
E. 金黄色葡萄球菌

正确答案：E。金黄色葡萄球菌

解析：血源性肺脓肿是因皮肤外伤感染、疖、痈、中耳炎或骨髓炎所致的脓毒症，菌栓经血行播散到肺，引起小血管栓塞、炎症、坏死而形成肺脓肿，常为两肺外野的多发性病变，致病菌以金黄色葡萄球菌（E对）、表皮葡萄球菌及链球菌为常见。铜绿假单胞菌和肺炎克雷伯菌常导致继发性肺脓肿（BD错）。肺脓肿是肺组织坏死形成的脓腔，肺炎链球菌（P46）不产生毒素，不引起组织坏死或形成空洞，故不易形成肺脓肿（C错）。流感嗜血杆菌肺炎呈支气管肺炎，表现为斑片状或多叶性浸润，无空洞，很少形成肺脓肿（A错）。